枳壳苦泄辛散，微寒不烈，功效是
A. 行滞消胀
B. 化痰散结
C. 疏肝破气
D. 燥湿化痰
E. 降气止呕

正确答案：A。行滞消胀

解析：本题考查的是枳壳的功效。枳壳苦泄辛散，微寒不烈，功效是行滞消胀（A对）。枳壳：【功效】理气宽中，行滞消胀。半夏：【功效】燥湿化痰，降逆止呕，消痞散结。青皮：【功效】疏肝破气（C错），消积化滞。陈皮：【功效】理气调中，燥湿化痰（D错）。旋覆花：【功效】消痰行水，降气止呕（E错）。